为预防近视，学校每年应安排几次视力检查
A. 1次
B. 2次
C. 3次
D. 4次
E. 5次

正确答案：B。2次